以下因素中，不会引起病理性颅内压增高的是
A. 脑震荡
B. 颅内肿瘤
C. 脑积水
D. 颅内出血
E. 狭颅症

正确答案：A。脑震荡

解析：颅腔与脑组织、脑脊液和血液是颅内压形成的物质基础。任何引起颅腔容积变小或颅腔内容物增加的因素均可导致颅内压升高。颅内肿瘤（B对）、脑积水（C对）、颅内出血（D对）时，颅腔内容物增加，可引起病理性颅内压增高。狭颅症（E对）时颅腔容积变小，亦可引起病理性颅内压增高。脑震荡（A错，为本题正确答案）是最轻微的脑损伤，多无可见的器质性损伤，不会引起颅内压增高。